某女，32岁。咳嗽2天，症见痰多咳喘、色黄黏稠、咽喉肿痛，舌质红，苔黄，脉滑数，宜选用的药是
A. 板蓝根
B. 金荞麦
C. 木蝴蝶
D. 马勃
E. 射干

正确答案：E。射干

解析：本题考查的是射干的主治病证。咳嗽2天，症见痰多咳喘、色黄黏稠、咽喉肿痛，舌质红，苔黄，脉滑数，宜选用的药是射干（E对）。射干：【主治病证】（1）咽喉肿痛（证属热结痰瘀者尤宜）。（2）痰多咳喘。（3）久疟疟母，闭经，痈肿，瘰疬、癥瘕。板蓝根（A错）：【主治病证】（1）温病发热、头痛或发斑疹。（2）咽喉肿痛，痄腮，痈肿疮毒，丹毒，大头瘟疫。金荞麦（B错）：【主治病证】（1）肺痈，肺热咳嗽，咽喉肿痛。（2）热毒痢疾，痈肿疮毒，瘰疬，蛇虫咬伤。（3）跌打损伤，风湿痹痛，痛经。木蝴蝶（C错）：【主治病证】（1）咽喉肿痛，音哑。（2）肝胃气痛。马勃（D错）：【主治病证】（1）风热或肺热之咽喉肿痛、咳嗽失音。（2）血热吐衄，外伤出血。